称成釉细胞瘤为临界瘤的原因是
A. 来源于牙源性上皮
B. 肿瘤增大可引起颌骨外板吸收
C. 有一定程度的局部浸润性
D. 可压迫神经，引起麻木
E. 肿瘤可长的很大，不易切除

正确答案：C。有一定程度的局部浸润性

解析：本题考查成釉细胞瘤为临界瘤的原因。口腔颌面部肿瘤依据其生长特性、生物学行为等可分为三类：良性肿瘤、恶性肿瘤、临界瘤。临界瘤是指：有些肿瘤虽为良性肿瘤，但是有一定程度的局部浸润性和恶变倾向（C对）。成釉细胞瘤是一种较常见的牙源性上皮性肿瘤，其中组织病理学大多来源于牙源性上皮（A错）；肿瘤增大可使颌骨外板变薄，甚至可引起颌骨外板吸收（B错）；可产生神经症状，压迫下牙槽神经，引起麻木（D错）；肿瘤可长的很大，不易切除（E错），以上为成釉细胞瘤的组织来源和临床表现，不是称其为临界瘤的原因。